数理统计法中监测数据呈正态分布的最具代表性的是
A. 几何均数
B. 算术均数
C. 方差
D. 中位数
E. 平方差

正确答案：B。算术均数

解析：本题考查数理统计法中监测数据呈正态分布的最具代表性的指标。数理统计法中，监测数据呈正态分布的最具代表性的指标是算术均数（B对CE错）。当监测数据呈对数正态分布，则宜用几何均数表示（A错）。当监测数据呈偏态分布，则宜用中位数（D错）。